以下哪项为口腔上皮的疣状、局灶性的良性增生
A. 寻常疣
B. 口腔结核
C. 扁平苔藓
D. 复发性阿弗他溃疡
E. 牙龈瘤

正确答案：A。寻常疣

解析：鳞状细胞乳头状瘤和寻常疣是一种口腔上皮的疣状、局灶性的良性增生。掌握“乳头状瘤及牙龈瘤”知识点。